根据传染病法的规定，不属于乙类传染病的是
A. 艾滋病
B. 脊髓灰质炎
C. 麻疹
D. 梅毒
E. 霍乱

正确答案：E。霍乱

解析：艾滋病（A对）、脊髓灰质炎（B对）、麻疹（C对）、梅毒（D对）均属于乙类传染病，霍乱属于甲类传染病（E错，为本题正确答案）。